某男，80岁。近年来，内障目暗、视物昏花。证属肝肾两亏、阴虚火旺，宜选用的成药是
A. 石斛夜光丸
B. 明目上清片
C. 黄连羊肝丸
D. 消栓通络胶囊
E. 复方血栓通胶囊

正确答案：A。石斛夜光丸

解析：本题考查的是石斛夜光丸的主治。某男，80岁。近年来，内障目暗、视物昏花。证属肝肾两亏、阴虚火旺，宜选用的成药是石斛夜光丸（A对）。石斛夜光颗粒：【主治】肝肾两亏、阴虚火旺所致的内障目暗，视物昏花。明目上清片（B错）：【主治】外感风热所致的暴发火眼、红肿作痛、头晕目眩、眼边刺痒、大便燥结、小便赤黄。黄连羊肝丸（C错）：【主治】肝火旺盛所致的目赤肿痛、视物昏暗、羞明流泪、胬肉攀睛。消栓通络胶囊（D错）：【主治】瘀血阻络所致的中风，症见神情呆滞、言语謇涩、手足发凉、肢体疼痛；缺血性中风及高脂血症见上述证候者。复方血栓通胶囊（E错）：【主治】血瘀兼气阴两虚证的视网膜静脉阻塞，症见视力下降或视觉异常、眼底瘀血征象、神疲乏力、咽干、口干等；以及血瘀兼气阴两虚的稳定型劳累性心绞痛，症见胸闷痛、心悸、心慌、气短、乏力、心烦、口干等。